食品安全风险监测工作的核心是
A. 采样和检验
B. 制订风险监测计划
C. 上报、汇总和分析数据
D. 发布、通报和监测结果跟踪评价
E. 收集、分析和研究判新食品安全风险信息

正确答案：B。制订风险监测计划

解析：本题考查食品安全风险监测工作的核心。食品安全风险监测的工作主要包括收集、分析和研究判断食品安全风险信息，制订风险监测计划，采样和检验，上报、汇总和分析数据，发布、通报和监测结果跟踪评价5个步骤。其中制订风险监测计划（B对ACDE错）是整个风险监测工作的核心。